靶向制剂分为被动靶向制剂、主动靶向制剂和物理化学靶向制剂三大类。属于物理化学靶向制剂的是
A. 脑部靶向前体药物
B. 磁性纳米囊
C. 微乳
D. 免疫纳米球
E. 免疫脂质体

正确答案：B。磁性纳米囊

解析：本题考查靶向制剂的分类。物理化学靶向制剂包括1.磁性靶向制剂：①磁性微球；②磁性纳米粒（B对）。2.栓塞性靶向制剂。3.热敏性靶向制剂。4.pH敏感的靶向制剂：①pH敏感脂质体；②pH敏感型结肠定位给药系统。脑部靶向前体药物（A错）、免疫纳米球（D错）和免疫脂质体（E错）为主动靶向制剂。微乳（C错）为被动靶向制剂。